在下列成土母岩中，含砷化物较高的岩石是
A. 火成岩
B. 页岩
C. 花岗岩
D. 冰晶岩
E. 云母

正确答案：B。页岩

解析：本题考查成土母岩中含砷化物较高的岩石。因成土母质（岩）的种类不同，致使土壤砷含量差别很大，含有机质较高的页岩（B对ACDE错）所形成的土壤含砷量较高；而含有机质较少的砂岩所形成的土壤含砷量较低。